头痛经久不愈，痛处固定属于
A. 风寒头痛
B. 风热头痛
C. 风湿头痛
D. 瘀血头痛
E. 肝阳头痛

正确答案：D。瘀血头痛

解析：本题考查的是头痛的辨证论治。头痛经久不愈，痛处固定属于瘀血头痛（D对）。头痛是临床常见的自觉症状，可单独出现，亦见于多种疾病的过程中。本节所讨论的头痛，是指因外感六淫或疠气、内伤杂病而引起的，以头痛为主要表现的疾病。西医学中的血管性头痛、神经性头痛、三叉神经痛、外伤后头痛、五官科疾病的头痛以及部分颅内疾病引起的头痛等，可参考此内容辨证论治。（一）风寒头痛（A错）：【症状】头痛时作，痛连项背，常有拘急收紧感，伴恶风畏寒，受风尤剧，口不渴。舌苔薄白，脉浮紧。（二）风热头痛（B错）：【症状】头痛而胀，甚则头痛如裂，发热或恶风，口渴欲饮，面红目赤，或便秘溲黄。舌尖红，苔黄，脉浮数。（三）肝阳头痛（E错）：【症状】头昏胀痛，两侧为重，心烦易怒，夜寐不宁，口苦面红，或兼胁痛。舌红苔黄，脉弦数。（四）血虚头痛：【症状】头痛隐隐，时时昏晕，心悸失眠，面色少华，神疲乏力，遇劳加重。舌质淡，苔薄白，脉细弱。（五）瘀血头痛：【症状】头痛经久不愈，痛处固定不移，痛如锥刺，或有头部外伤史。舌紫暗，或有瘀斑，瘀点，苔薄白，脉细或细涩。风湿头痛（C错）的症状，2022年考试指南未明确说明。